器械预清洁首要的步骤是
A. 冲洗
B. 化学浸泡
C. 擦拭
D. 干燥
E. 上泊

正确答案：B。化学浸泡

解析：本题考查器械预清洁。器械预清洁首要的步骤是化学浸泡（B对）。在进行器械的消毒灭菌前，一定要做好器械的预清洁的步骤，否则黏附在器械上的血渍等污染物不易清除。预清洁的首要步骤是进行化学浸泡，通常可选用1：32的合成酚溶液进行浸泡，以去除器械表面的细菌病毒。器械的消毒过程要经历消毒-清洗-灭菌的程序处理，再用清水冲洗（A错）、擦拭（C错），分类包装采用小型高温蒸汽灭菌器灭菌、干燥（D错），最后再进行上泊（E错）。